哪种疾患在青春期后有自愈趋势
A. 急性化脓性腮腺炎
B. 慢性复发性腮腺炎
C. 流行性腮腺炎
D. 舍格伦综合征
E. 腮腺良性肥大

正确答案：B。慢性复发性腮腺炎

解析：慢性复发性腮腺炎随年龄增长，发作次数减少，症状减轻，大多在青春期后痊愈。慢性复发性腮腺炎具有自愈性，因此，治疗以增强抵抗力、防止继发感染，减少发作为原则。掌握“慢性复发性腮腺炎”知识点。